下列降糖药服法，错误的是
A. 磺脲类药物在餐前半小时服用
B. 二甲双胍在餐前半小时服用
C. 噻唑烷二酮可每天一次服用
D. 瑞格列奈餐前15分钟内服用
E. α葡萄糖苷酶抑制剂在进餐时与第一口饭一起嚼服

正确答案：B。二甲双胍在餐前半小时服用

解析：二甲双胍的主要不良反应为消化道反应，应进餐时服药（B错，为本题正确答案）、从小剂量开始、逐渐增加剂量、分2～3次口服，最大剂量一般不超过2g/d，从而减小消化道不良反应。磺脲类药物建议从小剂量开始，早餐前半小时一次服用（A对），根据血糖逐渐增加剂量，剂量较大时改为早、晚餐前两次服药，直到血糖达到良好控制。噻唑烷二酮的常用药为罗格列酮和吡格列酮，罗格列酮4～8mg/d，每日1次或分2次服用；吡格列酮15～30mg/d，每日1次口服（C对）。格列奈类主要通过刺激胰岛素的早时相分泌而降低餐后血糖，具有吸收快、起效快和作用时间短的特点，主要用于控制餐后高血糖，也有一定降低空腹血糖的作用，于餐前15分钟内或进餐时服用（D对）。α葡萄糖苷酶抑制剂适用于以碳水化合物为主要食物成分，或空腹血糖正常（或不太高）而餐后血糖明显升高者，应在进食第一口食物后立即服用（E对）。